某男，49岁。症见大便脓血、里急后重、发热腹痛。医师处以香连丸，处方组成：萸黄连800g、木香200g。以上二味，粉碎成细粉，过筛，混匀，每100g粉末用米醋8g，加适量的水泛丸，干燥，即得。香连丸处方中萸黄连的显微鉴别特征是
A. 纤维束鲜黄色，壁稍厚，纹孔明显
B. 联结乳管含淡黄色细小颗粒状物
C. 树脂道碎片易见，含黄色块状分泌物
D. 纤维多而壁厚，附有小晶体（砂晶和方晶）
E. 纤维成束，周围薄壁细胞含草酸钙方晶，形成晶纤维

正确答案：A。纤维束鲜黄色，壁稍厚，纹孔明显

解析：本题考查的是黄连的显微鉴别。香连丸处方中萸黄连的显微鉴别特征是纤维束鲜黄色，壁稍厚，纹孔明显（A对）。黄连：【显微鉴别】粉末黄连、黄连片、酒黄连、姜黄连、萸黄连：中柱鞘纤维束鲜黄色，纤维壁稍厚，纺锤形或梭形，纹孔明显。石细胞类方形、类圆形、类长方形或近多角形，直径25～64μm，长至102μm，黄色，壁厚，壁孔明显。鳞叶表皮细胞绿黄色或黄棕色，细胞长方形或长多角形，壁微波状弯曲或作连珠状增厚。党参：【显微鉴别】粉末党参、党参片、米炒党参：联结乳管直径12～24μm，含淡黄色细小颗粒状物（B错）；石细胞斜方形、长方形或多角形，一端稍尖，壁较厚，纹孔稀疏。有菊糖，水合氯醛装片不加热，菊糖结晶呈扇形。人参：【显微鉴别】粉末人参、人参片：树脂道碎片易见，含黄色块状分泌物（C错）。草酸钙簇晶棱角锐尖，直径20～68μm。木栓细胞表面观为类方形或多角形，壁细波状弯曲。麻黄：【显微鉴别】粉末麻黄、蜜麻黄：气孔特异，内陷，保卫细胞侧面观呈哑铃状。纤维多而壁厚，附有小晶体（砂晶和方晶）（D错）。角质层极厚，呈脊状突起。甘草：【显微鉴别】粉末甘草、甘草片、炙甘草：纤维成束，直径8～14μm，壁厚，微木化，周围薄壁细胞含草酸钙方晶，形成晶纤维（E错）。草酸钙方晶多见。木栓细胞红棕色，多角形，微木化。具缘纹孔导管较大。